疱疹性咽峡炎中的病原体为
A. 柯萨奇病毒A组
B. 柯萨奇病毒B组
C. 埃可病毒
D. 单纯疱疹病毒
E. 水痘-带状疱疹病毒

正确答案：A。柯萨奇病毒A组

解析：疱疹性咽峡炎病原体为柯萨奇病毒A组，好发于夏秋季。掌握“急性上呼吸道感染”知识点。